龈下刮治前应了解的情况不包括
A. 牙周袋的形态范围
B. 牙周袋的深度
C. 龈下牙石的位置
D. 龈下牙石量
E. 龈下主要微生物

正确答案：E。龈下主要微生物

解析：本题考查龈下刮治前应了解的情况。龈下刮治前应了解的情况不包括龈下主要微生物（E错，为本题的正确答案）。了解龈下主要微生物可以针对微生物种类使用针对性的药物，属于牙周病药物治疗的原则之一；龈下刮治是牙周基础治疗的一个方法，是用机械方式去除龈下牙石菌斑，故不需了解微生物种类。龈下刮治是在牙周袋内操作，肉眼不能直视，为保证刮治效果，术前应先探明牙周袋的形态范围（A对）、牙周袋的深度（B对）、龈下牙石的位置（C对）、龈下牙石的量（D对），查明情况后方可刮治，做到心中有数，将牙石彻底去净，去除炎症刺激。